急性心肌梗死时，以下特异性最高的血清酶是
A. LDH
B. α-HBDH
C. AST
D. CK-MB
E. CK

正确答案：D。CK-MB